大黄附子汤主治的是
A. 食积便秘
B. 血虚便秘
C. 气虚便秘
D. 脾约便秘
E. 冷积便秘

正确答案：E。冷积便秘

解析：该题考查大黄附子汤的主治病证。大黄附子汤功能温里散寒，通便止痛。食积便秘应消食导滞，可用枳实导滞丸（A错）。血虚便秘应养血滋阴通便，多用润肠丸（B错）。气虚便秘应益气润肠，多用黄芪汤（C错）。脾约便秘应泻热导滞，润肠通便，多用麻子仁丸（D错）。冷积便秘应温里散寒，通便止痛，为大黄附子汤的主治病证（E对）。记忆：大黄附子汤又叫大黄附子细辛汤。金匮大黄附子汤，细辛散寒止痛良，温下治法代表方，寒积里实服之康。